药物引起脂肪肝的作用机制有
A. 促进脂肪组织释放游离脂肪酸入肝过多
B. 增加合成脂蛋白的原料如磷脂等
C. 刺激肝内合成三酰甘油增加
D. 破坏肝细胞内质网结构或抑制某些酶的合成导致脂蛋白合成障碍
E. 损害线粒体，脂肪酸氧化能力下降，使脂肪在肝细胞内沉积

正确答案：A、C、D、E。促进脂肪组织释放游离脂肪酸入肝过多；刺激肝内合成三酰甘油增加；破坏肝细胞内质网结构或抑制某些酶的合成导致脂蛋白合成障碍；损害线粒体，脂肪酸氧化能力下降，使脂肪在肝细胞内沉积

解析：本题考查药物引起脂肪肝的作用机制。药物引起脂肪肝的作用机制有：①游离脂肪酸供应过多，刺激垂体-肾上腺内分泌系统，使儿茶酚胺大量释放，导致脂肪组织释放游离脂肪酸入肝过多（A对）；②三酰甘油合成增加（C对）；③合成脂蛋白的原料如磷脂或组成磷脂的胆碱等物质缺乏（B错），脂蛋白合成障碍（D对）；④损害线粒体（E对），使线粒体肿胀，脂肪酸氧化能力下降，脂肪在肝细胞内沉积。